切断动物颈部迷走神经后动物的呼吸将变为
A. 变深变慢
B. 变浅变慢
C. 不变
D. 变浅变快
E. 变深变快

正确答案：A。变深变慢